右肾下段2.5cm×2.0cm肾癌，左肾无功能。应选择的治疗方法是
A. 免疫治疗
B. 随访观察
C. 根治性肾切除术
D. 肾部分切除术
E. 放射治疗

正确答案：D。肾部分切除术

解析：患者右肾下段2.5cm×2.0cm肾癌，左肾无功能，故应选择的治疗方法是右肾部分切除术（D对），可保留右肾部分功能，提高患者的生存质量。免疫治疗（A错）对预防和治疗转移癌有一定的疗效。肾癌为恶性肿瘤，一旦确诊后应尽早手术治疗，不应随访观察（B错），以免错过最佳手术时机。根治性肾切除术（C错）是肾癌最主要的治疗方法，适用于对侧肾功能完好的患者。肾癌具有多药物耐药基因，对放射治疗（E错）及化疗不敏感。